流行性出血热潜伏期一般为
A. 3～5天
B. 1周
C. 1～2周
D. 2～3周
E. 8～12个月

正确答案：C。1～2周

解析：流行性出血热潜伏期为4～46天，一般为1～2周（C对）。病程分为五期：发热期（1～2天出现）、低血压休克期（3～7天出现）、少尿期（始于6～8天）、多尿期（出现在9～14天）、恢复期。多数病例临床表现并不典型，或某期表现突出，或某期不明显而呈"越期"现象，或前二期、三期重叠，病情轻者常呈"越期"表现，重者则常见发热期、休克期和少尿期之间互相重叠。